急性化脓性腹膜炎的常见原因应除外
A. 腹腔内脏器穿孔
B. 损伤引起的腹壁或内脏破裂
C. 血源性感染
D. 手术污染
E. 吻合口瘘

正确答案：C。血源性感染

解析：急性化脓性腹膜炎可分为原发性和继发性两类，其中继发性腹膜炎占绝大多数（约占98％），原发性腹膜炎少见（约占2％）。继发性腹膜炎才是引起急性化脓性腹膜炎的主要原因，所以不选原发性因素——血源性传染。血源性感染（C错，为本题的正确答案）、上行性感染、直接扩散和透壁性感染等是原发性腹膜炎的原因，较少见，因此不是急性化脓性腹膜炎的常见原因。腹腔内脏器穿孔（A对）、损伤引起的腹壁或内脏破裂（B对）、手术污染（D对）、吻合口瘘（E对）均属于继发性腹膜炎的常见原因，即急性化脓性腹膜炎的常见原因。